肠道杆菌不具有的抗原是
A. O抗原
B. H抗原
C. K抗原
D. M抗原
E. Vi抗原

正确答案：D。M抗原

解析：肠道杆菌主要有菌体抗原（O抗原）、鞭毛抗原（H抗原）和荚膜抗原（K抗原或Vi抗原）。各菌种问可存在交叉抗原。掌握“志贺氏及沙门氏菌属”知识点。